下列除哪项外均是气血不足证的常见脉象
A. 虚
B. 细
C. 弱
D. 微
E. 结

正确答案：E。结

解析：结脉也可见于气血虚衰但此并非气血虚衰的常见脉象（E错，为本题正确答案）。虚脉（A对）见于虚证，多为气血两虚。细脉（B对）见于虚证或湿证。弱脉（C对）多见于阳气虚衰、气血两虚证。微脉（D对）多见于气血大虚，阳气衰微。